牡蛎的主治病证有
A. 阴虚动风
B. 瘰疬痰核
C. 自汗盗汗
D. 胃痛泛酸
E. 血热吐衄

正确答案：A、B、C、D。阴虚动风；瘰疬痰核；自汗盗汗；胃痛泛酸

解析：本题考查牡蛎的主治病证。牡蛎的主治病证有阴虚动风（A对）、瘰疬痰核（B对）、自汗盗汗（C对）、胃痛泛酸（D对）。牡蛎【主治病证】（1）阴虚阳亢之头晕目眩，阴虚动风。（2）烦躁不安，心悸失眠。（3）瘰疬痰核，癥瘕积聚。（4）自汗，盗汗，遗精，带下，崩漏。（5）胃痛泛酸。桑叶【主治病证】（1）风热感冒或温病初起之咳嗽头痛。（2）肺热燥咳。（3）肝阳眩晕，目赤肿痛，视物昏花。（4）血热吐衄（E错）。